不能通过垂直传播的病原体为
A. 艾滋病病毒（HIV）
B. 乙型肝炎病毒（HBV）
C. 梅毒螺旋体
D. 流行性乙型脑炎病毒
E. 风疹病毒

正确答案：D。流行性乙型脑炎病毒